以下关于侧生牙的说法正确的是
A. 侧生牙只有一侧的基部与颌骨相连
B. 侧生牙有完善的牙根
C. 侧生牙在大部分硬骨鱼中常见
D. 侧生牙比端生牙牢固
E. 侧生牙的基部在牙槽窝内生长

正确答案：D。侧生牙比端生牙牢固

解析：侧生牙：除牙齿的基部与颌骨相连以外，其一侧也附着于颌骨的内缘，此类牙虽无完善的牙根，但比端生牙牢固，如爬行动物的牙齿。掌握“牙的演化”知识点。